关于病菌致病因素的描述，错误的是
A. 病菌有黏附因子
B. 病菌有荚膜、微荚膜
C. 与病菌的胞外酶有关
D. 与病菌的内、外毒素有关
E. 与病菌侵入的数量并无密切关系

正确答案：E。与病菌侵入的数量并无密切关系

解析：本题考查病菌的致病因素。关于病菌致病因素的描述错误的是与病菌侵入的数量并无密切关系（E错，为本题的正确答案）。病菌有黏附因子（A对），细菌可借助其黏附并定植在宿主皮肤、黏膜上皮细胞表面，然后才能侵入组织细胞生长繁殖并扩散；病菌有荚膜、微荚膜（B对），是细菌致病重要的毒力因子，也是鉴别细菌的重要标志；细菌的致病力与病菌的胞外酶有关（C对），有利于病原菌的抗吞噬作用并向周围组织扩散；与病菌的内、外毒素有关（D对）；与病菌侵入的数量也有密切关系。